正确的干燥失重检查方法为
A. 称量瓶不需预先在相同条件下干燥至恒重
B. 供试品应平铺于称量瓶中，厚度一般不超过5mm
C. 干燥的温度一般为105℃
D. 干燥后应将称量瓶置干燥器内，放冷至室温再称量
E. 受热易分解或易挥发的药物可用干燥剂干燥

正确答案：B、C、D、E。供试品应平铺于称量瓶中，厚度一般不超过5mm；干燥的温度一般为105℃；干燥后应将称量瓶置干燥器内，放冷至室温再称量；受热易分解或易挥发的药物可用干燥剂干燥